女，34岁，停经，溢乳3个月，查体：体温36.5℃，脉搏80次/分，R18次/分，BP120/80mmHg，乳房挤压有少量乳白色液体，未触及肿块，余体格检查未见异常，该患者最可能的诊断是
A. 多囊卵巢综合症
B. 颅咽管瘤
C. 垂体柄损伤
D. 早期妊娠
E. 泌乳素瘤

正确答案：E。泌乳素瘤

解析：患者年轻女性（泌乳素瘤的好发人群），停经，溢乳3个月，查体：乳房挤压有少量乳白色液体，未触及肿块（泌乳素瘤常见临床表现），余体格检查未见异常，可初步诊断为泌乳素瘤（E对）。多囊卵巢综合征（A错）主要临床改变为月经紊乱、不孕、多毛、肥胖、色素沉着、双侧卵巢呈囊性增大。颅咽管瘤（B错）主要临床改变为下丘脑-垂体功能紊乱、颅内压增高、视力及视野障碍、尿崩症及神经和精神症状。垂体柄损伤（C错）主要临床表现为生长发育迟缓和尿崩症。早期妊娠（D错）有妊娠反应，但并无溢乳症状。